女，21岁，右大腿下端肿痛2个月，查体：T36.9℃，P85次/分，R18次/分，BP110/60mmHg。双肺呼吸音清，未闻及杂音，腹软，无压痛，未触及包块。右下腿下端肿胀、压痛。X线检查示股骨下端有界限不清的骨质破坏区，骨膜增生及放射状阴影。最可能的诊断是
A. 骨巨细胞瘤
B. 骨髓炎
C. 骨结核
D. 骨转移瘤
E. 骨肉瘤

正确答案：E。骨肉瘤

解析：青年女性患者，右大腿下端肿痛2个月（骨肉瘤临床表现），查体：T36.9℃（体温正常值36℃～37.3℃），P85次/分（正常60～100次/分），R18次/分（12～20次/分），BP110/60mmHg（正常值100～120/60～80mmHg）。X线检查见股骨下端有界限不清的骨质破坏区，伴有骨膜增生及放射状阴影表现（骨肉瘤典型影像学表现），结合患者临床表现及影像学检查，该患者最可能的诊断应为股骨下端骨肉瘤（E对）。骨巨细胞瘤（A错）（P776）好发于20～40岁，女性略多，好发部位为长骨干骺端和椎体，X线表现为肥皂泡样改变。骨髓炎（B错）常有高热、呕吐等全身性表现，典型X线表现为骨质破坏和死骨形成。。骨结核（C错）多见于脊柱，肱骨近端一般不出现，可有低热、盗汗等结核中毒症状，X线可见区域性骨质疏松和周围少量钙化的骨质破坏病灶。骨转移瘤（D错）（P779）多见于老年人，但本题中患者为21岁女孩。